患者夜寐盗汗，五心烦热，两颧色红，口渴，舌红少苔，脉细数。治疗应首选
A. 黄连阿胶汤
B. 黄连温胆汤
C. 当归六黄汤
D. 养阴清肺汤
E. 甘麦大枣汤

正确答案：C。当归六黄汤

解析：根据“夜寐盗汗”可知病为“汗证”；根据“五心烦热，两颧色红，口渴，舌红少苔，脉细数”可辨为“阴虚火旺证”，治疗应滋阴降火，用当归六黄汤（C对）。黄连阿胶汤为阴虚痢的代表方（A错）。黄连温胆汤为不寐之痰热扰心的代表方（B错）。养阴清肺汤主治阴虚肺燥之白喉（D错）。甘麦大枣汤为郁证心神失养证的代表方（E错）。